公共场所“卫生许可证”多长时间复核一次
A. 1年
B. 2年
C. 3年
D. 6个月
E. 3个月

正确答案：B。2年